男孩，7岁。水肿4天，伴血尿、尿少2天。查体：P112次/分，R33次/分，BP120/85mmHg，颜面、双下肢明显水肿，烦躁不安、气促，双肺底可闻及湿啰音，肝肋下1.5cm。尿常规：蛋白（＋）。尿沉渣镜检：RBC25/HP。目前应首选的药物是
A. 毛花苷丙
B. 硝普钠
C. 青霉素
D. 呋塞米
E. 地西泮

正确答案：D。呋塞米

解析：儿童男性患者，水肿4天，伴血尿、尿少2天。查体：颜面、双下肢明显水肿，烦躁不安、气促，双肺底可闻及湿啰音，肝肋下1.5cm。尿常规：蛋白（＋）。尿沉渣镜检：RBC25/HP（正常值＜3/HP）。综合患者的症状、体征，初步诊断为急性肾小球肾炎。目前应首选的药物是利尿药呋塞米（D对）。毛花苷丙（A错）常用于心源性水肿。硝普钠（B错）常用于高血压脑病的治疗。青霉素（C错）常用于感染存在时的抗感染治疗。地西泮（E错）为苯二氮䓬类抗焦虑药。